大黄治实热便秘，常配伍的药组是
A. 厚朴，枳实
B. 紫苏，陈皮
C. 石膏，知母
D. 薤白，青皮
E. 黄连，黄芩

正确答案：A。厚朴，枳实

解析：治疗实热便秘当以泻热导滞，润肠通便，厚朴能下气除满，以积实下气开痞散结，助厚朴行气而除满，二者与大黄相配伍，泻热破气，推荡积滞，以成速泻热结之功（A对）。